风热咳嗽，咯痰不爽的患者，宜选用的中成药有
A. 川贝枇杷颗粒
B. 复方枇杷叶膏
C. 养阴清肺糖浆
D. 川贝清肺糖浆
E. 蛇胆川贝液

正确答案：A、B。川贝枇杷颗粒；复方枇杷叶膏

解析：本题考查的是中成药的主治。风热咳嗽，咯痰不爽的患者，宜选用的中成药有川贝枇杷颗粒（A对）、复方枇杷叶膏（B对）。川贝枇杷颗粒，复方枇杷叶膏均是用于风热咳嗽，咯痰不爽的患者。养阴清肺糖浆（C错）用于咽喉干燥疼痛，干咳、少痰或无痰。川贝清肺糖浆（D错）用于干咳，咽干，咽痛。蛇胆川贝液（E错）用于痰多，气喘，胸闷，久咳不止。